咬肌间隙脓肿如需切开引流，切开的位置应是
A. 下颌支后缘绕过下颌角，距下颌下缘2cm处切开
B. 口内翼下颌皱襞内侧纵形切口
C. 下颌骨下缘下1～1.5cm作平行切口
D. 下颌骨下缘上2cm作平行切口
E. 口内翼下颌皱襞处横形切口

正确答案：A。下颌支后缘绕过下颌角，距下颌下缘2cm处切开

解析：咬肌间隙一旦脓肿形成应及时引流。常用口外途径切开引流，口外切口从下颌支后缘绕过下颌角，距下颌下缘2cm处切开，切口长3～5cm，逐层切开皮下组织、颈阔肌以及咬肌在下颌角度的部分附丽，用骨膜剥离器，由骨面推起咬肌进入脓腔，引出脓液，冲洗脓腔后填入盐水纱条引流。掌握“间隙感染概述、眶下间隙、咬肌间隙感染”知识点。